以下属于口腔医务人员个人保护措施的是
A. 手套
B. 口罩
C. 防护镜
D. 保护性工作服
E. 以上均是

正确答案：E。以上均是

解析：在口腔医疗工作中一般包括工作服、口罩、防护镜、手套等，称这些设备为“个人防护设备”。掌握“患者、医务人员及环境的防护”知识点。